光电荧光计中采用的第二块滤光片是为了
A. 获得一定的激发波长
B. 获得一定的吸收光波长
C. 获得较纯的荧光
D. 滤去非平行光
E. 滤去荧光

正确答案：A。获得一定的激发波长